属于兴奋剂目录所列的品种，并且药品零售企业可以经营的是
A. 阿片生物碱类止痛剂
B. 利尿剂
C. 抗肿瘤药物
D. 蛋白同化制剂

正确答案：B。利尿剂

解析：本题考查兴奋剂的管理层次。属于兴奋剂目录所列的品种，并且药品零售企业可以经营的是利尿剂（B对）。国家体育总局、商务部、国家卫生健康委、海关总署、国家药品监督管理局于2019年12月30日联合发布2020年兴奋剂目录公告，《2020年兴奋剂目录》自2020年1月1日起施行。《2020年兴奋剂目录》分为两个部分。第一部分：兴奋剂品种；第二部分：对运动员进行兴奋剂检查的有关规定。我国公布的《2020年兴奋剂目录》，将兴奋剂品种分为七大类，共计349个品种（比2019年兴奋剂目录新增5个品种），具体品种详见《2020年兴奋剂目录》。该目录中品种类别分布如下：·肽类激素品种68个。·麻醉药品品种14个。·刺激剂（含精神药品）品种79个。·药品类易制毒化学品品种3个。·医疗用毒性药品品种1个。·其他品种（β受体阻滞剂、利尿剂等）115个。需要说明的有两点，一是目录所列物质包括其可能存在的盐及光学异构体，所列蛋白同化制剂品种包括其可能存在的盐、酯、醚及光学异构体；二是目录所列物质中属于药品的，还包括其原料药及单方制剂。兴奋剂的管理层次：依照《反兴奋剂条例》的规定，我国对含兴奋剂药品的管理可体现为三个层次。1.实施特殊管理：兴奋剂目录所列禁用物质属于麻醉药品（A错）、精神药品、医疗用毒性药品和药品类易制毒化学品的，其生产、销售、进口、运输和使用，依照《药品管理法》和有关行政法规的规定实施特殊管理。2.实施严格管理：兴奋剂目录所列禁用物质属于我国尚未实施特殊管理的蛋白同化制剂（D错）、肽类激素的，依照《药品管理法》《反兴奋剂条例》的规定，参照我国有关特殊管理药品的管理措施和国际通行做法，其生产、销售、进口和使用环节实施严格管理。3.实施处方药管理：除上述实施特殊管理和严格管理的品种外，兴奋剂目录所列的其他禁用物质，实施处方药管理。抗肿瘤药物（C错）不属于兴奋剂目录所列的品种。